介导适应性体液免疫应答的细胞是
A. 单核细胞
B. 巨噬细胞
C. 中性粒细胞
D. B淋巴细胞
E. 自然杀伤细胞

正确答案：D。B淋巴细胞